薄束核和楔束核叙述错误的是
A. 传导本体感觉和精细触觉
B. 传导通路的第二级神经元
C. 发出纤维形成内侧丘系交叉
D. 发出纤维形成对侧的内侧丘系
E. 止于背侧丘脑的腹后内侧核

正确答案：E。止于背侧丘脑的腹后内侧核

解析：薄束核和楔束核为躯干四肢本体感觉、精细触觉（A对）传导通路中的第二级神经元（B对）。上述二核发出纤维交叉至对侧称侧丘系交叉（C对），而后上行于延髓中线两侧，称内侧丘系（D对），止于背侧丘脑的腹后外侧核（E错，为本题正确答案）。